按照《处方药与非处方药分类管理办法（试行）》，非处方药分甲、乙两类，是根据药品的
A. 可靠性
B. 稳定性
C. 安全性
D. 有效性
E. 经济性

正确答案：C。安全性

解析：本题考查非处方药的分类。按照《处方药与非处方药分类管理办法（试行）》，非处方药分甲、乙两类，是根据药品的安全性（C对）。非处方药是指由国家药品监督管理局公布的，不需要凭执业医师和执业助理医师处方，消费者可以自行判断、购买和使用的药品。国家根据药品的安全性，非处方药又被分为甲、乙两类，就用药安全性而言，乙类非处方药相对于甲类非处方药更安全。